反映组织摄氧量的指标是
A. 动脉血氧含量
B. 静脉血氧含量
C. 静脉血氧饱和度
D. P50
E. 动－静脉血氧含量差

正确答案：E。动－静脉血氧含量差

解析：反映组织摄氧能力的指标是动-静脉血氧含量差（E对），正常时约5ml/dl。